晚发性矽肺是指
A. 接触矽尘20年以后出现的矽肺
B. 矽尘作业工人晚年出现的矽肺
C. 接触一段时间高浓度矽尘后，脱离接触若干年后才出现的矽肺
D. 脱离矽尘作业后立即出现的矽肺
E. 上述各种情况都不是

正确答案：C。接触一段时间高浓度矽尘后，脱离接触若干年后才出现的矽肺

解析：本题考查晚发性矽肺的定义。晚发性矽肺是指有些接尘者，虽接触较高浓度矽尘，但在脱离粉尘作业时X线胸片未发现明显异常，或发现异常但尚不能诊断为矽肺，在脱离接尘作业若干年后被诊断为矽肺（C对ABDE错）。区别于长期接触高浓度、高游离二氧化硅含量的粉尘，1～2年即发病的“速发性矽肺”。